下列关于酮体的描述中，错误的是
A. 酮体包括乙酰乙酸、β羟丁酸和丙酮
B. 合成原料是丙酮酸氧化生成的乙酰COA
C. 只能在肝的线粒体内生成
D. 酮体只能在肝外组织氧化
E. 酮体是肝输出能量的一种形式

正确答案：B。合成原料是丙酮酸氧化生成的乙酰COA